胃蛋白酶可用于
A. 镇咳
B. 平喘
C. 祛痰
D. 止吐
E. 助消化

正确答案：E。助消化

解析：本题考查胃蛋白酶的作用。助消化（E对）的药物主要有胃蛋白酶、胰酶等。镇咳药（A错）有右美沙芬、可待因等。平喘药（B错）临床常见的有沙丁胺醇,特布他林等。祛痰药（C错）有氨溴索、氯化铵、化痰片等药物。促胃肠动力（止吐）药（D错）主要有多潘立酮、莫沙必利等。